呃声沉缓，膈间及胃脘不舒，遇寒加剧，得热则减，舌质白润，脉沉缓，证属
A. 胃寒呃逆
B. 阴虚呃逆
C. 阳虚呃逆
D. 胃热呃逆
E. 气机郁滞呃逆

正确答案：A。胃寒呃逆

解析：根据患者“呃声沉缓，膈间及胃脘不舒”可辨病为呃逆，伴有“遇寒加剧，得热则减，舌质白润，脉沉缓”的表现，可辨证为胃寒呃逆（A对）。阴虚呃逆的临床表现为呃声短促而不连续，口舌干燥，不思饮食，或有烦渴，或食后饱胀，大便干结；舌红苔少，脉细数（B错）。阳虚呃逆的临床表现为呃声低长无力，气不得续，泛吐清水，脘腹不舒，喜暖喜按，手足不温，食少乏力，大便溏薄，舌质淡，苔薄白，脉沉细（C错）。胃热呃逆临床表现为呃声洪亮有力，冲逆而出，口臭烦渴，多喜冷饮，脘腹满闷，大便秘结，小便短黄；舌红苔黄或燥，脉滑数（D错）。气机郁滞呃逆的临床表现为呃逆连声，常因情志不畅而诱发或胸胁满闷，脘腹胀满，或有嗳气纳呆，肠鸣矢气；苔薄，脉弦（E错）。